女，31岁。口服有机磷农药30ml后出现口吐白沫、呼吸困难立即入院，经洗胃、碘解磷定及阿托品治疗后症状有所缓解，但24小时后再次出现呼吸困难。查体：R16-18次／分，BP112/65mmHg，昏迷，呼吸浅慢，皮肤湿冷，瞳孔针尖样，双肺可闻及湿啰音，心率50-60/分。急诊处理正确的是
A. 立即气管插管机械通气治疗，然后给予解毒剂治疗
B. 立即解毒治疗，导泻，必要时气管插管
C. 立即解毒治疗，重复洗胃，必要时气管插管
D. 立即气管插管机械通气，强心、利尿治疗
E. 立即给予呼吸兴奋剂＋解毒治疗

正确答案：A。立即气管插管机械通气治疗，然后给予解毒剂治疗

解析：患者有有机磷农药接触史，并且存在口吐白沫、呼吸困难等中毒相关症状，考虑有机磷中毒。经洗胃、碘解磷定及阿托品治疗后症状有所缓解，但24小时后再次出现呼吸困难，昏迷，皮肤湿冷，查体瞳孔针尖样，双肺湿啰音，心率50-60/分。考虑中间型综合征，多发生在重度OPI中毒后24-96小时及ChE复能药用量不足病人，经治疗胆碱能危象消失，突然出现呼吸肌麻痹，引起通气障碍性呼吸困难或衰竭，可导致死亡。治疗应立即给予人工机械通气，同时应用氯解磷定（P885）（A对BC错）。利尿可通过增加尿量促进毒物排出，但患者存在心功能障碍，不宜使用利尿剂（D错）。呼吸兴奋剂作用于颈动脉体和主动脉体的化学感受器兴奋呼吸中枢，增加通气量，患者呼吸肌衰竭宜使用呼吸兴奋剂（E错）。